肝糖原合成中葡萄糖载体是
A. CDP
B. ADP
C. UDP
D. TDP
E. GDP

正确答案：C。UDP

解析：肝糖原合成中葡萄糖载体是UDP（C对）。首先，葡糖-6-磷酸变构生成葡糖-1-磷酸，后者再与尿苷三磷酸（UTP）反应生成尿苷二磷酸葡萄糖（UDPG）和焦磷酸。其中UDPG可看作“活性葡萄糖”，是体内的葡萄糖供体。糖原合酶的作用下，UDPG的葡萄糖基转移到糖原引物的非还原性末端，合成糖原。